早期发现宫颈癌的最佳方法是
A. 阴道镜检查
B. 碘试验
C. 宫颈刮片细胞学检查
D. 宫颈活体组织检查
E. 宫颈锥形切除

正确答案：C。宫颈刮片细胞学检查